中度“X”形腿标准是两膝关节靠拢，踝关节间距为
A. 2cm
B. 3cm
C. 3～6cm
D. 3～4cm
E. 6cm

正确答案：C。3～6cm

解析：本题考查维生素D缺乏性佝偻病“X”型腿的相关内容。膝内翻“X”型腿标准：X型腿是指两足并立时，首先是两侧膝关节碰在一起，而两内踝不能靠拢。轻度“X”型腿标准：双踝间距小于3cm，中度：3～6cm（C对ABDE错），重度：6cm以上。